种植体应用的主要材料为
A. 金合金
B. 钛金属
C. 铝合金
D. 镍铬合金
E. 钴铬合金

正确答案：B。钛金属

解析：种植体：又称植入体，系植入骨组织内替代天然牙根的部分，具有固位、支持、传导力的作用。目前，种植体材料主要以具有良好生物相容性的钛金属为主，如纯钛、钛合金等。根据种植体顶端与其周围骨及黏膜水平的关系，可以分为骨水平种植体和软组织水平种植体。掌握“种植义齿的组成和修复治疗原则”知识点。